环境影响预测评价方法不包括
A. 统计推断法
B. 趋势外推法
C. 因果模式预测法
D. 类比分析法
E. 专家系统法

正确答案：B。趋势外推法

解析：本题考查环境影响预测评价方法。环境影响预测是要了解某区域环境在受到污染的过程中，有关环境质量参数在时间和空间上的变化量。预测结果的正确性除了对上述资料的掌握程度外，还取决于预测方法。预测方法包括统计推断法（A对）、因果模式预测法（C对）、类比分析法（D对）和专家系统法（E对）。趋势外推法（B错，为本题正确答案）又称为趋势延伸法，它是根据预测变量的历史时间序列揭示出的变动趋势外推将来，以确定预测值的一种预测方法。